我国肺动脉栓塞最常见病因是
A. 血栓
B. 心脏病
C. 肿瘤
D. 妊娠分娩
E. 遗传因素

正确答案：A。血栓

解析：我国造成肺动脉栓塞的栓子95%以上来自下肢的深静脉血栓（A对），下肢易形成深静脉血栓，脱落后经体循环回流至右心室后泵入肺动脉中造成栓塞。心脏病（B错）形成的血栓（例如房颤）易经体循环栓塞于脑、脾等脏器动脉，少见于肺动脉。肿瘤（C错）可栓塞肺动脉，但肿瘤形成的栓子不如血栓多见，不是造成肺栓塞最常见的原因。妊娠分娩（D错）时可因羊水大量进入体循环而栓塞肺动脉，但发病率低，不是肺栓塞最常见的原因。遗传因素（E错）常引起患者反复静脉血栓形成和栓塞，也不是最常见的原因。